原发性肝癌肝内播散最主要的途径是
A. 经淋巴管
B. 经肝静脉
C. 直接侵犯
D. 经肝动脉
E. 经门静脉

正确答案：E。经门静脉

解析：原发性肝癌肝内播散最主要的途径是经门静脉（E对）分支。经淋巴管（A错）和经肝静脉（B错）均为原发性肝癌的肝外转移途径。原发性肝癌很少直接侵犯（C错）邻近器官。